关于药品零售企业陈列与储存药品管理要求的说法，正确的有
A. 将处方药与非处方药集中摆放，都不得采用开架自选的方式陈列和销售
B. 第二类精神药品应当单独陈列，毒性中药品种和罂粟壳不得陈列
C. 拆零销售的药品应当集中存放于拆零专柜或专区
D. 不同批号的中药饮片装斗前，应当清斗并记录

正确答案：C、D。拆零销售的药品应当集中存放于拆零专柜或专区；不同批号的中药饮片装斗前，应当清斗并记录

解析：本题考查的是药品零售企业药品陈列要求。药品零售企业药品陈列要求：药品的陈列应当符合以下要求：按剂型、用途以及储存要求分类陈列，并设置醒目标志，类别标签字迹清晰、放置准确；药品放置于货架（柜），摆放整齐有序，避免阳光直射；处方药、非处方药分区陈列，并有处方药、非处方药专用标识；处方药不得采用开架自选的方式陈列和销售（A错）；外用药与其他药品分开摆放；拆零销售的药品集中存放于拆零专柜或者专区（C对）；第二类精神药品、毒性中药品种和罂粟壳不得陈列（B错）；冷藏药品放置在冷藏设备中，按规定对温度进行监测和记录，并保证存放温度符合要求；中药饮片柜斗谱的书写应当正名正字；装斗前应当复核，防止错斗、串斗；应当定期清斗，防止饮片生虫、发霉、变质；不同批号的饮片装斗前应当清斗并记录（D对）；经营非药品应当设置专区，与药品区域明显隔离，并有醒目标志。